人工喂养的婴儿估计每日奶量的计算是根据
A. 能量需要量
B. 胃容量
C. 身高
D. 体表面积
E. 年龄

正确答案：A。能量需要量

解析：人工喂养的婴儿估计每日奶量的计算是根据能量需要量（A对）来对婴儿进行喂养，胃容量（B错）、身高（C错）、体表面积（D错）、年龄（E错）都无法直接体现婴儿对能量的需要，不能用于计算人工喂养的婴儿每日奶量。